1998年我国卫生部确定的每年的“全国高血压日”是
A. 4月7日
B. 5月31日
C. 9月28日
D. 10月8日
E. 12月1日

正确答案：D。10月8日